医疗机构药师工作职责是
A. 参与临床药物治疗，进行个体化药物治疗方案的设计与实施
B. 参与开展药学查房、会诊、病例讨论和疑难、危重患者的医疗救治
C. 参与诊断、书写药历、行使处方权
D. 开展抗菌药物临床应用监测，实施处方点评与超常预警
E. 开展药物利用评价和药物临床应用研究

正确答案：A、B、D、E。参与临床药物治疗，进行个体化药物治疗方案的设计与实施；参与开展药学查房、会诊、病例讨论和疑难、危重患者的医疗救治；开展抗菌药物临床应用监测，实施处方点评与超常预警；开展药物利用评价和药物临床应用研究

解析：本题考查的是医院药师职责。医疗机构药师工作职责是参与临床药物治疗，进行个体化药物治疗方案的设计与实施（A对）；参与开展药学查房、会诊、病例讨论和疑难、危重患者的医疗救治（B对）；开展抗菌药物临床应用监测，实施处方点评与超常预警（D对）；开展药物利用评价和药物临床应用研究（E对）。医院药师职责：医院药师的工作职责包括：①负责药品采购供应、处方或者用药医嘱审核、药品调剂、静脉用药集中调配和医院制剂配制，指导病房（区）护士请领、使用与管理药品；②参与临床药物治疗，进行个体化药物治疗方案的设计与实施，开展药学查房，为患者提供药学专业技术服务；③参加查房、会诊、病例讨论和疑难、危重患者的医疗救治，协同医师做好药物使用遴选，对临床药物治疗提出意见或调整建议，与医师共同对药物治疗负责；④开展抗菌药物临床应用监测，实施处方点评与超常预警，促进药物合理使用；⑤开展药品质量监测，药品严重不良反应和药品损害的收集、整理、报告等工作；⑥掌握与临床用药相关的药物信息，提供用药信息与药学咨询服务，向公众宣传合理用药知识；结合临床药物治疗实践，进行药学临床应用研究；⑦开展药物利用评价和药物临床应用研究；⑧参与新药临床试验和新药上市后安全性与有效性监测等。医疗机构应当加强对药学专业技术人员的培养、考核和管理，制订培训计划，组织药学专业技术人员参加毕业后规范化培训和继续医学教育，将完成培训及取得继续医学教育学分情况，作为药学专业技术人员考核、晋升专业技术职务任职资格和专业岗位聘任的条件之一。